妊娠数月，面浮肢肿，下肢尤甚，按之没指，心悸气短，腰痠乏力。其诊断是
A. 虚型子肿
B. 湿热型子肿
C. 气滞型子肿
D. 肾虚型子肿
E. 郁脾虚型子肿

正确答案：D。肾虚型子肿

解析：妊娠数月，面浮肢肿，下肢尤甚，按之没指是为肾虚水肿之象，心悸气短，腰痠乏力是肾虚之象（D对）。脾虚型子肿，其水肿常遍及全身，皮薄光亮，按之凹陷不起（A错）。湿热型子肿，除出现水肿外，有湿热之征，常见头身困重，心烦焦躁，口渴恶心，舌苔黄腻，脉数等（B错）。气滞型子肿，水肿常始于两足，渐延于腿。皮色不便，随按随起（C错）。肝郁脾虚型水肿，除出现水肿外，会伴有肝郁脾虚之征，常见胁胀作痛，情志抑郁，腹胀，便溏等（E错）。